发生在年轻恒牙的牙髓炎多见于
A. 慢性闭锁性牙髓炎
B. 慢性溃疡性牙髓炎
C. 慢性增生性牙髓炎
D. 急性牙髓炎
E. 牙髓网状变性

正确答案：C。慢性增生性牙髓炎

解析：本题考查慢性增生性牙髓炎。发生在年轻恒牙的牙髓炎多见于慢性增生性牙髓炎（C对）。慢性增生性牙髓炎多见于年轻恒牙，患牙有较大的穿髓孔，且根尖孔粗大，牙髓血运丰富，使炎性牙髓组织增生呈息肉状经穿髓孔突出，又称为牙髓息肉。